男性患者，46岁，大便时，有肿物从肛门脱出，便后可自行回纳，伴少量便血，此症状反复发作5年，近一周来症状加剧，应诊断为
A. 一期内痔
B. 二期内痔
C. 三期内痔
D. 直肠脱垂
E. 直肠息肉

正确答案：B。二期内痔

解析：内痔分度：I度：便时带血，滴血或喷射状出血，便后出血可自行停止，无痔脱出（A错）。II度：常有便血，排便时有痔脱出，便后可自行回纳（B对）。III度：偶有便血，排便或久站、咳嗽、劳累、负重时痔脱出，需用手还纳（C错）。IV度：偶有便血，痔脱出不能还纳，多伴有感染、水肿、糜烂和坏死，疼痛剧烈。直肠脱垂可见直肠粘膜或直肠环状脱出，有螺旋状皱折，表面光滑，无静脉曲张，一般不出血，脱出后有粘液分泌（D错）。直肠息肉多见于儿童，脱出息肉一般为单个，头圆而有长蒂，表面光滑，质较痔核稍硬，活动度大，容易出血，但多无射血、滴血现象（E错）。